女婴，11个月。人工喂养为主。体检发现血Hb偏低。目前最适宜添加的辅食是
A. 肝泥
B. 鸡蛋羹
C. 米粉
D. 西红柿泥
E. 苹果泥

正确答案：A。肝泥

解析：女婴，11个月（已适合泥状，碎食物），Hb偏低，辅食肝泥中富含铁元素，且以血红素二价铁的形式存在，消化吸收率很高，有助于预防及治疗缺铁性贫血。